传染病流行过程的定义是
A. 各种传染源不断向外界排出病原体
B. 病原体侵袭易感者
C. 病原体在中间宿主中的传代
D. 病原体通过一定的传播途径，不断更迭其宿主的过程
E. 病原体在宿主体内生长、繁殖的过程

正确答案：D。病原体通过一定的传播途径，不断更迭其宿主的过程